桑菊饮与银翘散中均含有的药物是
A. 杏仁、桑叶
B. 桔梗、薄荷
C. 银花、竹叶
D. 连翘、杏仁
E. 苇根、荆芥

正确答案：B。桔梗、薄荷

解析：本题考查方剂的组成，银翘散组成 连翘 银花 苦桔梗 薄荷 竹叶 生甘草 芥穗 淡豆豉 牛蒡子。桑菊饮组成 桑叶 菊花 杏仁 连翘 薄荷 苦桔梗 生甘草 苇根。桑菊饮与银翘散中均含有的药物是桔梗、薄荷。桔梗开宣肺气而止咳利咽，薄荷疏散风热、清利头目、且可解毒利咽（B对）。